4周岁小儿的身长应为
A. 90cm
B. 98cm
C. 100cm
D. 103cm
E. 110cm

正确答案：D。103cm

解析：第十版中医儿科学教材中2岁后至12岁儿童的身高的计算公式为：身高（cm）=70﹢7×年龄。2022年执业医师则可考试指导用书（2022年中医执业医师考试大纲）中2岁后至12岁儿童的身高的计算公式为：身高（cm）=75﹢7×年龄。以新大纲为标准，该儿童4周岁，75+7×4=103cm（D对）。